治疗急性呼吸窘迫综合征最有效的措施是
A. 应用呼气末正压通气
B. 持续高浓度吸氧
C. 持续低浓度吸氧
D. 积极给予对症支持治疗
E. 早期应用糖皮质激素

正确答案：A。应用呼气末正压通气

解析：ARDS主要病理特征是透明膜形成，导致弥散功能障碍，患者出现顽固的低氧血症，因此需采取呼气末正压通气（PEEP）（A对）来提高肺泡内气体交换。高浓度给氧（B错）可提高PaO₂，但是多数患者需使用机械通气。持续低浓度吸氧（C错）适用于伴明显CO₂潴留的低氧血症。对症支持（D错）是对症治疗，为一般性措施，不是最有效的措施。早期应用糖皮质激素（E错）在ARDS中的治疗价值尚不确定。